青少年根尖周炎最好选用哪种治疗方法
A. 干髓术
B. 根管治疗
C. 塑化治疗
D. 空管治疗
E. 安抚治疗

正确答案：B。根管治疗

解析：本题考查根管治疗的适应证。青少年患根尖周炎时，如果患牙为年轻恒牙，需进行根尖诱导成形术，诱导牙根发育完成或促进根管口封闭，再进行常规永久充填。如果患牙牙根已发育完成，直接进行根管治疗（B对），消除根尖区炎症促进牙周组织愈合。干髓术（A错）适用于麻醉效果不佳的全部牙髓坏死的牙髓炎。青少年牙齿若采用塑化治疗（C错），若以后炎症复发，根管再治疗困难，带来拔牙风险。空管治疗（D错）适用于牙髓病，不适用于根尖周病。安抚治疗（E错）适用于可复性牙髓炎，不适用于根尖周炎。